具有结肠袋和肠脂垂的是
A. ileum
B. caecum
C. jejunum
D. rectum
E. vermiformappendix

正确答案：B。caecum

解析：具有结肠袋和肠脂垂的为盲肠和结肠，盲肠英文为caecum(B对)，结肠英文为colon(ACDE错)。